水俣病的典型症状
A. 脊柱受压缩短变形，终日疼痛呼叫
B. 视野向心性缩小，感觉障碍
C. 氟斑牙
D. 黑脚病
E. 脱发（斑秃或全秃）

正确答案：B。视野向心性缩小，感觉障碍

解析：本题考查水俣病的典型症状。水俣病是慢性甲基汞中毒的一种，是长期食用含甲基汞污染的鱼虾贝类，使甲基汞侵入脑神经细胞而引起的一种综合性疾病。其典型症状是视野向心性缩小、感觉障碍（B对ACDE错）、共济运动失调、语言和听力障碍等。